女，31岁取环后10天，发热3天。体：T38.6℃，P98次/分，R23次/分，BP100/80mmHg，宫颈举痛（＋），子宫压痛，右侧附件区可触及腊肠型肿物，触痛明显，活动度差。该患者最可能的诊断是
A. 输卵管妊娠
B. 生殖器结核
C. 盆腔炎性疾病
D. 卵巢上皮性癌
E. 子宫内膜异位症

正确答案：C。盆腔炎性疾病

解析：中年女性患者，取环后10天，发热3天，宫颈举痛（＋），子宫压痛，右侧附件区可触及腊肠型肿物，触痛明显，活动度差。综合患者的症状、体征和辅助检查，该患者最可能的诊断是盆腔炎性疾病（C对）。输卵管妊娠（A错）主要表现为停经、腹痛、阴道不规则流血。生殖器结核（B错）多有结核病史及结核中毒症状。卵巢上皮性癌（D错）早期癌多无明显症状，较晚期的病人可有消瘦、低热、食欲缺乏及胃肠功能紊乱等症状，盆腔检查可触及囊实性肿块。子宫内膜异位症（E错）多表现为进行性加剧的痛经或伴不孕史。